亚洲人易发生某种代谢酶基因突变，导致部分患者使用奥美拉唑时，其体内该药物的AUC明显增加，该代谢酶是
A. CYP2D6
B. CYP3A4
C. CYP2C19
D. CYP2C9
E. CYP1A2

正确答案：C。CYP2C19

解析：本题考查奥美拉唑的代谢。亚洲人易发生某种代谢酶基因突变，导致部分患者使用奥美拉唑时，其体内该药物的AUC明显增加，该代谢酶是CYP2C19（C对）。由于CYP2C19的基因多态性，导致该酶的活性及第一代质子泵抑制剂的代谢表型发生了变异，使不同个体间的CYP2C19表现型存在着强代谢型（EM）和弱代谢型（PM）之分，近20%的亚洲人为弱代谢型。而奥美拉唑是酶CYP2C19的作用底物。CYP2D6（A错）是多态性的氧化酶。CYP3A4（B错）是体内最重要的代谢酶，与临床1/3以上药物代谢有关。阿瑞匹坦是CYP2C9（D错）的诱导剂，会导致一些经此酶代谢的药物血药浓度降低。CYP1A2（E错）用于芳胺、亚硝胺、芳烃、咖啡因的氧化。